有关阿托品的应用各项叙述，错误的是
A. 可以用于各种内脏绞痛
B. 能解救有机磷酸酯类中毒
C. 用于缓慢型心律失常
D. 可用于全麻前给药以抑制腺体分泌
E. 可用于治疗前列腺肥大

正确答案：E。可用于治疗前列腺肥大

解析：阿托品临床应用有①内脏平滑肌痉挛：适用于各种内脏绞痛（A对）②抑制腺体分泌：用于全身麻醉前给药，以减少呼吸道腺体及唾液腺的分泌（D对）③眼科：虹膜睫状体炎、检查眼底、眼光配眼镜④缓慢性心律失常（C对）⑤休克⑥有机磷酸酯类中毒（B对）（E错，为本题正确答案）。